在一个局部地区或集体单位中，短时间内突然出现很多症状相同的患者。这些患者多有相同的传染源或传播途径。大多数患者常同时出现在该病的最短和最长潜伏期之间，此描述属于何种流行强度
A. 散发
B. 暴发
C. 流行
D. 大流行
E. 大暴发

正确答案：B。暴发